肽链合成后经羟化生成的是
A. 丝氨酸
B. 羟脯氨酸
C. 胱氨酸
D. 蛋氨酸
E. 苏氨酸

正确答案：B。羟脯氨酸